药用部位为带叶茎枝的药材是
A. 鱼腥草
B. 荆芥
C. 槲寄生
D. 蒲公英
E. 半枝莲

正确答案：C。槲寄生

解析：本题考查的是槲寄生的药用部位。药用部位为带叶茎枝的药材有槲寄生（C对）。槲寄生：【来源】为桑寄生科植物槲寄生的干燥带叶茎枝。鱼腥草（A错）：【来源】为三白草科植物蕺莱的新鲜全草或干燥地上部分。荆芥（B错）：【来源】为唇形科植物荆芥的干燥地上部分。蒲公英（D错）：【来源】为菊科植物蒲公英、碱地蒲公英或同属数种植物的干燥全草。半枝莲（E错）：【来源】为唇形科植物半枝莲的干燥全草。